可用于预防HIV（人免疫缺陷病毒）感染者巨细胞病毒视网膜炎的药物是
A. 金刚烷胺
B. 阿昔洛韦
C. 更昔洛韦
D. 恩替卡韦
E. 奥司他韦

正确答案：C。更昔洛韦

解析：本题考查更昔洛韦。可用于预防HIV（人免疫缺陷病毒）感染者巨细胞病毒视网膜炎的药物是更昔洛韦（C对）。更昔洛韦用于预防和治疗危及生命或视觉的受巨细胞病毒感染的免疫缺陷患者，以及预防与巨细胞病毒感染有关的器官移植患者。金刚烷胺（A错）用于帕金森病、帕金森综合征、药物诱发的锥体外系疾患，一氧化碳中毒后帕金森综合征及老年人合并有脑动脉硬化的帕金森综合征，也用于防治A型流感病毒所引起的呼吸道感染。阿昔洛韦（B错）用于生殖器疱疹病毒感染初发和复发单纯疱疹病毒感染病例，对反复发作病例口服本品用作预防，免疫功能正常者带状疱疹和免疫缺陷者轻症病例的治疗，以及免疫缺陷者水痘的治疗。恩替卡韦（D错）用于病毒复制活跃，血清丙氨酸氨基转移酶（ALT）持续升高或肝脏组织学显示有活动性病变的慢性成人乙型肝炎的治疗。奥司他韦（E错）用于成人和1岁及1岁以上儿童的甲型和乙型流感治疗，用于成人和13岁及13岁以上青少年的甲型和乙型流感的预防。